煤矿井防尘主要措施是
A. 加强矿井通风
B. 推广湿式作业
C. 使用防尘口罩
D. 测定粉尘浓度和分散度
E. 做好定期健康检查

正确答案：B。推广湿式作业